我国卫生事业的性质是
A. 政府实行福利政策的事业
B. 政府通过购买形式为人民提供服务的事业
C. 政府许可的盈利性事业
D. 政府实行一定福利政策的社会公益事业
E. 政府实行的社会公益事业

正确答案：D。政府实行一定福利政策的社会公益事业

解析：我国卫生事业的性质是政府实行一定福利政策的社会公益事业（D对）。